β-内酰胺酶抑制剂有
A. 克拉维酸
B. 舒巴坦
C. 丙磺舒
D. 他唑巴坦
E. 氨曲南

正确答案：A、B、D。克拉维酸；舒巴坦；他唑巴坦